流脑的细菌学检查主要包括
A. 尿样沉渣痰培养和血培养
B. 血培养咽拭子尿沉渣检查
C. 脑脊液培养咽拭子大便培养
D. 血培养咽拭子培养大便培养
E. 脑脊液涂片皮肤瘀点涂片和血培养

正确答案：E。脑脊液涂片皮肤瘀点涂片和血培养

解析：细菌学检查1.涂片检查 皮肤瘀点处的组织液或离心沉淀后的脑脊液做涂片染色，阳性率为60%-80%瘀点涂片简便易行，应用抗生素早期亦可获得阳性结果，是早期诊断的重要方法。2.细菌培养 取瘀斑组织液、血或脑脊液进行培养。应在使用抗菌药物前收集标本。如有脑膜炎奈瑟菌生长，应做药物敏感性试验（E对）。